位于大脑半球内的是
A. .侧脑室
B. 第三脑室
C. 第四脑室
D. 中脑水管
E. 中央管

正确答案：A。.侧脑室

解析：位于大脑半球内的腔隙称为侧脑室（A对）。第三脑室（B错）位于两侧间脑之间。第四脑室（C错）位于延髓、脑桥、小脑之间。中脑水管（D错）为第三脑室与第四脑室之间的通道。中央管（E错）位于脊髓中央，纵贯脊髓全长。